女，36岁。前置胎盘大出血入院行手术治疗。术中输注红细胞悬液26单位，机采血小板2个治疗量，手术创面渗血不止。实验室检查：Hb100g/L，血小板90×10⁹/L，凝血酶原时间（PT）为21s（正常对照为11～15s），血浆纤维蛋白原0.6g/L。此时应输注
A. 全血
B. 红细胞悬液
C. 浓缩血小板
D. 新鲜冰冻血浆
E. 浓缩白（粒）细胞

正确答案：D。新鲜冰冻血浆

解析：青年女性患者，大出血后入院治疗，经输注红细胞、血小板后，Hb100g/L（正常110～150g/L），血小板90×10⁹/L（正常值100～300×10⁹/L），凝血酶原时间（PT）为21s（正常对照为11～15S，凝血酶原时间延长提示凝血因子的缺乏），血浆纤维蛋白原0.6g/L（正常值2～4g/L，血浆纤维蛋白原为血液凝固因子之一），因新鲜冰冻血浆中含丰富的凝血因子，适用于多种凝血因子缺乏症、肝胆疾病引起的凝血障碍和大量输库存血后的出血倾向，故应输注新鲜冰冻血浆（D对）。原则上，失血量在30%以下时，不输全血（A错）。BCE项不含或少含凝血因子（BCE错）。